男，34岁。近1个月来反复出现阵发性恐惧胸闷濒死感，多次到医院急诊就诊。心电图检查未见异常。为此担心苦恼，但仍能坚持工作，既往体健。该患者最可能的诊断是
A. 疑病症
B. 惊恐障碍
C. 甲状腺功能亢进症
D. 强迫症
E. 冠心病

正确答案：B。惊恐障碍

解析：该男性患者近1个月来反复出现阵发性恐惧、胸闷、濒死感，持续时间半小时左右，最可能诊断为惊恐发作（急性焦虑性发作）（B对）。疑病症病前常有过分关注自身健康，可表现为全身不适，疼痛，常四处求医但查无实据，与本例不符（A错）。强迫症以强迫观念为核心症状，即自我抵抗，欲罢不能的体验，缺乏惊恐发作的典型特征（反复出现的恐惧、濒死感）（D错）。既往体健，心电图正常，故排除心血管疾病（E错）。